根据《中华人民共和国药品管理法》及其实施条例，关于医疗机构药剂管理的说法，错误的是
A. 医疗机构购进药品必须有真实、完整的药品购进记录
B. 医疗机构向患者提供药品应当与诊疗范围相适应
C. 计划生育技术服务机构可向患者提供与其经批准的服务范围相一致的药品
D. 个体诊所应当按照省级卫生行政部门分级管理目录制定本诊所的供应目录
E. 医疗机构审核和调配处方的药剂人员必须是依法经资格认定的药学技术人员

正确答案：D。个体诊所应当按照省级卫生行政部门分级管理目录制定本诊所的供应目录

解析：本题考查药品管理。个人设置的门诊部、诊所等医疗机构不得配备常用药品和急救药品以外的其他药品。常用药品和急救药品的范围和品种,由所在地的省、自治区、直辖市人民政府卫生行政部门会同同级人民政府药品监视管理部门规定（D错，为本题正确答案）。